下列哪种脉象主虚证
A. 滑
B. 结
C. 促
D. 动
E. 疾

正确答案：E。疾

解析：疾脉脉来急疾，一息七八至。多见于阳极阴竭，元气欲脱之证，主虚证（E对）。滑脉往来流利，应指圆滑，如盘走珠。多见于痰湿、食积和实热等病证，亦是青壮年的常脉，妇女的孕脉（A错）。结脉脉来缓慢，时有中止，止无定数。多见于阴盛气结、寒痰血瘀（B错）。促脉脉来数而时有一止，止无定数。多见于阳盛实热、气血痰食停滞；亦见于脏气衰败（C错）。动脉见于关部，滑数有力，常见于惊恐、疼痛等症（D错）。